以下哪一项不是维生素B₁的特点
A. 碱性环境中易被氧化
B. 对亚硫酸盐不敏感
C. 在酸性环境中稳定
D. 缺乏时可致脚气病
E. 其需要数量与能量代谢有关

正确答案：B。对亚硫酸盐不敏感